女，32岁。大量呕血1天。伴恶心，之后出现黑便。既往有饥饿性上腹痛，伴烧心、反酸，进食后可缓解。最可能的诊断是
A. 食管胃底静脉曲张破裂
B. 急性胃黏膜病变出血
C. 胃癌出血
D. 胃溃疡出血
E. 十二指肠溃疡出血

正确答案：E。十二指肠溃疡出血

解析：年轻女性，呕血黑便，饥饿痛，进食缓解，考虑十二指肠溃疡出血（E对）。食管胃底静脉曲张破裂有肝脏病史，无饥饿痛，无进食缓解现象（A错）。急性胃黏膜病变出血出血量少，无饥饿痛，无进食缓解现象（B错）。胃癌出血无饥饿痛，无进食缓解现象（C错）。胃溃疡出血为进食痛，无进食缓解现象（D错）。